左向右分流型的先天性心脏病是
A. 动脉导管未闭
B. 肺动脉狭窄
C. 主动脉缩窄
D. 右位心
E. 大血管错位

正确答案：A。动脉导管未闭

解析：左向右分流型的先天性心脏病是动脉导管未闭，动脉导管开放是胎儿期重要的血循环通道，出生后，随着首次呼吸的建立，动脉血氧分压增高，肺循环阻力降低，动脉导管逐渐关闭，经过数月到1年，在解剖学上也完全关闭。若持续开放，产生病理生理改变，即称动脉导管未闭（A对）。肺动脉狭窄是指右心室与肺动脉间的通道，因先天性畸形产生的狭窄，而室间隔完整（B错）。主动脉缩窄是指先天性胸主动脉局限性狭窄，该处管腔变小甚至闭塞，血流受阻（C错）。右位心是指出生后心脏的大部或全部位于胸腔的右侧，或由于先天性心脏及大动脉发育异常（D错）。大血管错位由于分隔心球和动脉干的螺旋形隔反方向进行或直行，造成主动脉由右心室发出，肺动脉由左心室发出的现象（E错）。